以上疾病中可以出现体温上升，皮肤捻发音，呈现大理石样斑纹的是
A. 破伤风
B. 肺结核
C. 气性坏疽
D. 脑出血
E. 胸腔积液

正确答案：C。气性坏疽

解析：气性坏疽随着病情发展，可以导致溶血性贫血、蛋白尿、黄疸以及皮下积气出现捻发音，静脉回流受阻导致皮肤表面出现大理石样斑纹的情况。掌握“特殊性感染”知识点。